对胰的说法，何者不对
A. 是人体内大消化腺之一
B. 可分为头、颈、体、尾四部
C. 可分泌胰液和胰岛素
D. 胰液和胰岛素经胰管排入十二指肠降部
E. 副胰管开口于十二指肠降部

正确答案：D。胰液和胰岛素经胰管排入十二指肠降部

解析：胰是大消化腺之一(A对)，可分为头、颈、体、尾四部分(B对)，由外分泌部分泌胰液，内分泌部分泌胰岛素(C对)，胰液经副胰管排入十二指肠降部(D错，为本题正确答案)，副胰管开口于十二指肠降部的十二指肠小乳头(E对)。